关于神经系统发育特征的描述中哪一条是错误的
A. 脑重量出生时约为350g
B. 婴儿期脑细胞不断繁殖，脑重增长最快，1岁末可达出生时1.5倍
C. 6~7岁时接近成人脑重
D. 小脑在出生后6个月达到生长高峰
E. 小脑在6岁时发育达到成人水平

正确答案：B。婴儿期脑细胞不断繁殖，脑重增长最快，1岁末可达出生时1.5倍